蛋白质生物学价值的高低主要取决于
A. 蛋白质真消化率
B. 蛋白质表观消化率
C. 蛋白质的含量
D. 食物蛋白质所含氨基酸的数量
E. 蛋白质所含必需氨基酸的含量和比值

正确答案：E。蛋白质所含必需氨基酸的含量和比值

解析：蛋白质生物学价值是评价蛋白质营养价值的一项重要指标，反映蛋白质被利用的程度，生物价越高，表明蛋白质被机体利用的程度越高，而蛋白质被机体利用程度与氨基酸模式（蛋白质中各种必需氨基酸的构成比例）有关（E对）。蛋白质消化率反映的是蛋白质和氨基酸被吸收的程度（AB错）。蛋白质含量与生物价一样，是评价蛋白质营养价值的一项指标（C错）。食物蛋白质中氨基酸数量与生物及没有直接关系，如果蛋白质中必需氨基酸少，氨基酸数量再多也不能被人体利用（D错）。